慢性肺源性心脏病肺、心功能代偿期表现错误的是
A. 咳嗽、咳痰、气促
B. 活动后心悸
C. 呼吸困难
D. 肺部偶有干、湿性啰音
E. 肺动脉瓣区第二心音减弱

正确答案：E。肺动脉瓣区第二心音减弱

解析：肺、心功能代偿期：症状：咳嗽、咳痰、气促，活动后心悸、呼吸困难、乏力和活动耐力下降。体征：不同程度的发绀和肺气肿体征。肺部偶有干、湿性啰音。心脏体征：心音遥远，肺动脉瓣区第二心音亢进，三尖瓣区可出现收缩期杂音或剑突下心脏搏动增强。掌握“慢性肺源性心脏病”知识点。